下列属于联络纤维的是
A. 扣带
B. 胼胝体
C. 穹窿
D. 内囊的纤维
E. 前连合

正确答案：A。扣带

解析：大脑半球的髓质主要由联系皮质各部和皮质下结构的神经纤维组成，可分为三类：联络纤维、连合纤维、投射纤维。联络纤维是联系同侧半球内各部分皮质的纤维，包括钩束、上纵束、下纵束、扣带（A对）；连合纤维是连合左、右半球皮质的纤维，包括胼胝体（B错）、前连合（E错）、穹窿（C错）；投射纤维由大脑皮质与皮质下各中枢间的上、下行纤维组成，它们大部分经过内囊，因而内囊的纤维（D错）为投射纤维。